1-OH蒽醌的IR光谱中，Vco峰的特征是
A. 1675-1621cm⁻¹处有一强峰
B. 1678-1661cm⁻¹和1626-1616cm⁻¹处有两个吸收峰
C. 1675-1647cm⁻¹和1637-1621cm⁻¹处有两个吸收峰
D. 1625cm⁻¹和1580cm⁻¹处有两个吸收峰
E. 1580cm⁻¹处有一个吸收峰

正确答案：C。1675-1647cm⁻¹和1637-1621cm⁻¹处有两个吸收峰

解析：本题考查的是乙酸-丙二酸途径化合物的红外光谱特征。1-OH蒽醌的IR光谱中，Vco峰的特征是1675-1647cm⁻¹和1637-1621cm⁻¹处有两个吸收峰（C对）。1，8-二OH蒽醌的IR光谱中，Vco峰的特征是1678-1661cm⁻¹和1626-1616cm⁻¹处有两个吸收峰（B错）。